研究者欲对新生儿黄疸的病因作研究，选择了100名患此病的婴儿，并同时在同一所医院选择了100名未患此病的新生儿，然后查阅婴儿母亲的妇科和分娩记录以确定产前和分娩中的各种暴露因素，该研究属何种类型的研究
A. 现况调查
B. 病例对照研究
C. 队列研究
D. 临床试验研究

正确答案：B。病例对照研究

解析：本题考查病例对照研究的概念。病例对照研究（B对ACD错）是以当前已经确诊的患有某特定疾病的一组病人作为病例组，以不患有该病但具有可比性的一组个体作为对照组，通过询间、实验室检查或复查病史，搜集研究对象既往对各种可能的危险因素的暴露史，测量并采用统计学检验，比较病例组与对照组各因素暴露比例的差异是否具有统计学意义，然后评估各种偏倚对研究结果的影响，并借助病因推断技术，判断某个或某些暴露因素是否为疾病的危险因素，从而达到探索和检验病因假说的目的。